下列哪项不符合辅食添加原则
A. 从细到粗，从稀到稠
B. 在健康时添加
C. 辅食种类应单一化
D. 如小儿拒绝吃以后应再试
E. 从少到多

正确答案：C。辅食种类应单一化

解析：本题考查婴儿喂养方法。添加过渡期食物（辅食）的原则：由少到多（E对），由稀到稠，由细到粗（A对），由一种到多种（C错，为本题正确答案）。应在小儿健康（B对）、消化功能正常时逐步添加，如小儿拒绝吃以后应再试（D对）。